心脏骤停早期诊断最佳指标是
A. 瞳孔突然散大
B. 测不到血压
C. 颈动脉和股动脉搏动消失
D. 呼吸停止
E. 面色苍白和口唇发绀

正确答案：C。颈动脉和股动脉搏动消失

解析：心脏骤停的主要临床表现为：①意识丧失或伴短阵抽搐；②心音、大动脉搏动消失，测不到血压（B错）；③呼吸断续或停止（D错）；④瞳孔散大（A错）；⑤面色苍白（E错）或发绀。其中早期诊断最佳指标是意识突然丧失伴颈动脉和股动脉脉搏消失（C对）。